放射卫生防护的基本措施不包括
A. 内照射防护
B. 外照射防护
C. 控制辐射源
D. 防护应当实现最优化
E. 大部分照射必须有正当理由

正确答案：E。大部分照射必须有正当理由